氯化消毒副产物有可能导致的男性癌症是
A. 肝癌和脑瘤
B. 结肠直肠癌和膀胱癌
C. 肝癌和膀胱癌
D. 胰腺癌和结肠癌
E. 胃癌和直肠癌

正确答案：B。结肠直肠癌和膀胱癌

解析：本题考查氯化消毒副产物有可能导致的男性癌症。氯化消毒副产物系指在氯化消毒过程中的氯与水中有机物反应所产生的卤代烃类化合物。一些氯化消毒副产物已被证实具有遗传毒性、致癌性、生殖发育毒性等，对人群健康构成潜在威胁，有可能导致男性患结肠直肠癌和膀胱癌（B对ACDE错）。